急性肺栓塞病症常见的病症是
A. 肺血栓栓塞症
B. 肺脂肪栓塞综合症
C. 肺羊水栓塞综合症
D. 肺空气栓塞综合症
E. 肺瘤栓栓塞综合症

正确答案：A。肺血栓栓塞症

解析：造成急性肺栓塞的栓子绝大多数多为下肢深静脉的血栓，也可为右心的附壁血栓等，故急性肺栓塞的常见病症为肺血栓栓塞症（A对）。肺脂肪栓塞（B错）、肺羊水栓塞（C错）、肺空气栓塞（D错）和肺瘤栓栓塞综合征（E错）均可见于急性肺栓塞病，但都不常见。